女，25岁。因心脏手术，麻醉药过量，病人出现呼吸、心跳停止，此时除进行人工呼吸及心脏按压术外，应采取哪项急救措施
A. 静注毛花苷丙
B. 静滴去甲肾上腺素
C. 阿托品心内注射
D. 肾上腺素心内注射
E. 异丙肾上腺素静注

正确答案：D。肾上腺素心内注射

解析：肾上腺素用于溺水、麻醉和手术过程中的意外、药物中毒、传染病和心脏传导阻滞等所致的心脏骤停。对电击所致的心脏骤停用肾上腺素配合心脏除颤器或利多卡因等除颤。异丙肾上腺素对于有心律失常、心肌损害、心悸、诱发心绞痛、头痛、震颤、头晕、虚脱、该患者心脏手术，所以不能用。掌握“肾上腺素”知识点。